目前所知能在无生命培养基中生长繁殖的最小的原核细胞型微生物是
A. 细菌
B. 病毒
C. 支原体
D. 衣原体
E. 立克次体

正确答案：C。支原体

解析：支原体科为无细胞壁的原核细胞型微生物，细胞膜含有胆固醇，可通过除菌滤器，二分裂繁殖，是目前所知能在无生命培养基中生长繁殖的最小的原核细胞型微生物。掌握“支原体”知识点。